完带汤适用于下列病的哪种证候
A. 脾虚
B. 肾阴虚
C. 肾阳虚
D. 湿热
E. 热毒

正确答案：A。脾虚

解析：带下过多脾虚证多因脾气虚弱，运化失司，湿邪下注，损伤任带，使任脉不固，带脉失约而为带下过多，故选用完带汤以健脾益气，升阳除湿（A对）。带下证肾阳虚证多用内补丸（《女科切要》）以温肾培元，固涩止带（C错）。带下证肾阴虚夹湿证多用知柏地黄丸以滋肾益阴，清热利湿（B错）。带下证湿热下注证多用止带方（《世补斋·不谢方》）以清热利湿佐以杀虫解毒）（D错）。带下证热毒蕴结证多用五味消毒饮（《医宗金鉴》）以清热解毒（E错）。